下列不属于下颌第三磨牙拔除适应证的是
A. 反复引起冠周炎
B. 因正畸需要
C. 可能为颞下颌关节紊乱病的病因
D. 可能为原因不明疼痛的病因
E. 无症状的骨埋伏

正确答案：E。无症状的骨埋伏

解析：骨埋伏阻生牙的拔除难度大，如无任何临床症状，可以观察。掌握“阻生牙拔除术”知识点。